使湿物料在热空气的吹动下上下翻腾的干燥设备称为
A. 红外干燥器
B. 喷雾干燥机
C. 流化床干燥机
D. 微波干燥器
E. 箱式干燥器

正确答案：C。流化床干燥机